《医疗事故处理条例》将医疗事故分为四级的根据是
A. 行为主体特定性
B. 医疗活动的违法性
C. 诊疗护理的过失性
D. 对患者人身造成的危害程度
E. 医疗过失同损害后果的因果关系

正确答案：D。对患者人身造成的危害程度

解析：《医疗事故处理办法》根据对患者人身造成的危害程度（D对），将医疗事故分为三级，后来进行了大幅度修订，出台了新的《医疗事故处理条例》，将医疗事故由三级增加为四级。医疗活动的违法性（B错）、诊疗护理的过失性（C错）和医疗过失同损害后果的因果关系（E错）是医疗事故技术鉴定书（P333）所包含的内容。